用于人工冬眠
A. 哌替啶
B. 吗啡
C. 两者皆有
D. 两者皆无

正确答案：A。哌替啶